慢性病防治的基本原则不包括
A. 高危人群为主
B. 三级预防并重
C. 以健康教育和健康促进为主要手段
D. 以社区和家庭为基础
E. 生命全程预防

正确答案：A。高危人群为主

解析：慢性病的发生、发展一般依从正常人→高危人群→（亚临床状态）→疾病→并发症的过程，从任何一个阶段实施干预，都将产生明显的效果，因此应做到全人群策略和高危人群策略并重（A错，为本题正确答案）。其中三级预防并重（B对）、以健康教育和健康促进为主要手段（C对）、以社区和家庭为基础（D对）和生命全程预防（E对）都是在制订慢性病防治的策略和选择防治措施时要考虑的原则。